血栓外痔好发于，肛门齿线下
A. 截石位3、7、11点
B. 截石位3、9点
C. 截石位6、12点
D. 截石位1、8点
E. 截石位4、10点

正确答案：B。截石位3、9点

解析：血栓性外痔是指痔外静脉破裂出血，血积皮下而形成的血凝块，其特点是肛门部突然剧烈疼痛，并有紫暗色血块，好发于膀胱结石位3、9点（B对）。好发于截石位3、7、11的是内痔及混合痔（A错）。好发于截石位6、12点处的为结缔组织外痔，常由肛裂引起，又称哨兵痔或裂痔（C错）。没有好发于截石位1、8点和截石位4、10点的痔（DE错）。